女，70岁。跌倒后感右髋部疼痛1小时来诊。X线片检查示右股骨颈头下型骨折，Pauwels角为60°。最适宜的治疗方法是
A. 手术治疗
B. 右下肢皮牵引
C. 石膏固定
D. 休息制动
E. 手术复位

正确答案：A。手术治疗

解析：老年女性患者，右股骨颈头下型骨折，患者Pauwels角为60º（外展型骨折Pauwels角＜30°，内收型骨折Pauwels角＞50°），为内收型骨折，骨折稳定性差，故不能行保守治疗，需行手术治疗（A对），对于全身情况尚好的高龄病人多采用人工关节置换术。右下肢皮牵引（B错）、石膏固定（C错）、休息制动（D错）均为非手术治疗措施。该患者骨折稳定性较差，单纯的手术复位（E错）不能起到良好的效果。